重庆开县油气田井喷事件中，泄漏出的剧毒窒息性气体是
A. 氟化氢
B. 硫化氢
C. 甲基异氢酸酯
D. 氰化氢
E. 一氧化碳

正确答案：B。硫化氢

解析：本题考查重庆开县油气田井喷事件中，泄漏出的剧毒窒息性气体。重庆开县油气田井喷事件中，泄漏出的剧毒窒息性气体是硫化氢（B对ACDE错）。高浓度硫化氢气体吸入，可使暴露人群出现意识不清、昏迷、抽搐、死亡。